女性，45岁。间断腹泻，排黏液稀糊样便3年，伴有腹痛，排便后腹痛缓解，无消瘦，上述症状常于工作紧张时出现。最可能的诊断为
A. 溃疡性结肠炎
B. 慢性细菌性痢疾
C. 肠易激综合征
D. 阿米巴痢疾
E. 结肠癌

正确答案：C。肠易激综合征

解析：该病例慢性病史，反复发作，最主要症状是腹痛、排便习惯和粪便性状改变，精神紧张可诱使症状复发或加重，但全身健康状况却不受影响，体重无下降，综合以上考虑该患者为功能性疾病可能性最大，即肠易激综合征，但要确诊还需进一步除外其他器质性疾病。溃疡性结肠炎、慢性细菌性痢疾及阿米巴痢疾多见黏液脓血便。掌握“肠易激综合征”知识点。